患者，男，50岁，2周前发现右下后牙龈有小包。平时无明显不适，曾在外院照X片。查见右下第一前磨牙咬合面龋洞深，探无感觉，叩诊异常感。右下第一磨牙近中根尖部龈瘘管。X片见右下第一前磨牙根尖X线透射区不规则，边界模糊，右下第三磨牙前倾阻生，余未见异常。主诉牙应诊断
A. 根尖囊肿
B. 慢性牙髓炎
C. 慢性牙周炎
D. 根尖肉芽肿
E. 慢性根尖周脓肿

正确答案：E。慢性根尖周脓肿

解析：本题考查慢性根尖周炎。三种骨破坏病变的慢性根尖周炎（E对）的X线影像表现。